小肠是吸收的最主要部位。这主要与小肠的哪项特点有关
A. 长度长
B. 肠壁厚
C. 通透性高
D. 面积大
E. 消化酵多

正确答案：D。面积大